含有烟酰胺的辅酶是
A. TPP
B. FAD
C. FMN
D. NADP⁺
E. 辅酶Q

正确答案：D。NADP⁺

解析：本题考查辅酶。含有烟酰胺的辅酶是NADP⁺（D对）。（1）NADP⁺是烟酰胺腺嘌呤二核苷酸磷酸（辅酶Ⅱ）。（2）硫胺素即维生素B₁，它在生物体内的辅酶形式是硫胺素焦磷酸（TPP）（A错）。（3）黄素单核苷酸（FMN）和黄素腺嘌呤二核苷酸（FAD）是维生素B₂与核苷酸形成的有机化合物，两者均通过维生素B₂中的异咯嗪环进行可逆的加氢和脱氢反应。FMN（C错）、FAD（B错）发挥传递氢和电子的作用，是黄素蛋白的辅基。（4）泛醌又称辅酶Q（E错）（coenzymeQ，CoQ或Q），是一种脂溶性醌类化合物，其结构中异戊二烯单位的数目因物种而异，人体内的Q是10个异戊二烯单位连接的侧链，用Q₁₀表示。